氨苯蝶啶的作用包括
A. 利尿同时可能引起高血钾
B. 利尿作用较强
C. 作用于远端小管和集合管
D. 促进K⁺-Na⁺交换
E. 常与噻嗪类利尿药合用

正确答案：A、C、E。利尿同时可能引起高血钾；作用于远端小管和集合管；常与噻嗪类利尿药合用